控制哮喘最有效的药物是
A. 糖皮质激素
B. β2受体激动剂
C. 白三烯调节剂
D. 氨茶碱
E. 抗胆碱药

正确答案：A。糖皮质激素

解析：糖皮质激素，简称激素，是目前控制哮喘最有效的药物（A对）。β2受体激动剂是缓解哮喘症状的首选药物（B错）白三烯调节剂可作为控制轻度哮喘的较好选择（C错）。氨茶碱适合夜间哮喘的治疗（D错），注意静脉注射时应缓慢进行。抗胆碱药适用于夜间哮喘及痰多患者（E错）。